临床行气管切开术时，切口位置不宜低于第五气管软骨环，其原因为
A. 引起喉狭窄
B. 伤及食管
C. 伤及颈总动脉
D. 伤及气管后壁
E. 伤及头臂干

正确答案：E。伤及头臂干

解析：本题考查气管切开术。临床行气管切开术时，切口位置不宜低于第五气管软骨环，第五气管软骨环毗邻头臂干即无名动脉，切口位置低于第五气管软骨环易伤及头臂干（E对）。